某男，60岁。患皮肤瘙痒3年，刻下症见全身遍布抓痕、痂皮、黑色斑点，时起脓疱，自觉奇痒，搔抓不已，遇热及夜间更甚，痛苦不堪。医师诊断为疥癣，准备为其配制杀虫止痒外用药膏，宜选用的药物是
A. 硫黄
B. 雄黄
C. 轻粉
D. 蟾酥
E. 铅丹

正确答案：A。硫黄

解析：本题考查的是硫黄的功效与主治病证。诊断为疥癣，配制杀虫止痒外用药膏，宜选用的药物硫黄（A对）。硫黄：【功效】外用解毒杀虫止痒，内服补火助阳通便。【主治病证】（1）疥癣，湿疹，秃疮，阴疽恶疮。（2）肾阳不足之阳痿、小便频数，肾虚喘促。（3）虚冷便秘。雄黄（B错）：【功效】解毒，杀虫，燥湿祛痰，截疟定惊。【主治病证】（1）痈疽疔疮，疥癣，虫蛇咬伤。（2）虫积腹痛。（3）哮喘，疟疾，惊痫。轻粉（C错）：【功效】外用杀虫、攻毒、敛疮；内服祛痰消积，逐水通便。【主治病证】（1）疥癣，梅毒，疮疡溃烂。（2）痰涎积滞，水肿鼓胀兼二便不利。蟾酥（D错）：【功效】解毒消肿，止痛，开窍醒神。【主治病证】（1）痈疽疔疮，咽喉肿痛，龋齿作痛。（2）痧胀腹痛吐泻、甚则昏厥。铅丹（E错）：【功效】外用拔毒止痒，敛疮生肌；内服坠痰镇惊，攻毒截疟。【主治病证】（1）疮疡溃烂，黄水湿疮。（2）惊痫癫狂。（3）疟疾。